女，55岁。发现右侧下颌角处瘘管2个月。检查见瘘口处有小片死骨排出。X线片示下颌骨骨质破坏。入院后全麻下行下颌骨骨髓炎病灶清除术，关于术后创口处理的措施，错误的是
A. 手术清除病灶后作初期缝合
B. 放置引流物，引流口要大
C. 合理全身应用抗菌药物
D. 不轻易打开敷料观察，避免感染
E. 拆线时间至少在1周以后

正确答案：D。不轻易打开敷料观察，避免感染

解析：本题考查感染创口的处理。女，55岁。发现右侧下颌角处瘘管2个月。检查见瘘口处有小片死骨排出。X线片示下颌骨骨质破坏。入院后全麻下行下颌骨骨髓炎病灶清除术，关于术后创口处理的措施，错误的是不轻易打开敷料观察，避免感染（D错，为本题的正确答案）。无菌创口和污染创口除为拔出引流物及怀疑创口感染时，一般不轻易打开检视。颌骨骨髓炎行病灶清除术后严密缝合（A对），常规放置引流物，引流口要大（B对），术后应配合抗菌药物（C对），感染创口应覆盖敷料，并定时检视和换药，一般应在一周以后拆线（E对）。